可治疗麻风并具有广谐抗菌作用的是
A. 链霉素
B. 乙胺丁醇
C. 异烟肼
D. 氯喹
E. 利福平

正确答案：E。利福平